常见的心理咨询方式不包括
A. 门诊心理咨询
B. 信函心理咨询
C. 电话心理咨询
D. 专题心理咨询
E. 固定心理咨询

正确答案：E。固定心理咨询

解析：常用的心理咨询的方式有以下几种：1)门诊心理咨询；2)信函心理咨询；3)电话心理咨询；4)专题心理咨询；5)互联网心理咨询。E项为干扰项，没有这种心理咨询方式。掌握“临床心理咨询”知识点。